肠热腑实证的临床表现是
A. 腹痛腹胀，暴泻如水，肛门灼热
B. 大便溏薄，时干时稀，排便不爽
C. 下痢脓血，里急后重，身热口渴
D. 腹满硬痛，大便秘结，日晡潮热
E. 大便燥结，艰涩难下，口干口臭

正确答案：D。腹满硬痛，大便秘结，日晡潮热

解析：里热炽盛，伤津耗液，肠道失润，邪热与肠中燥屎内结，腑气不通，故脐腹胀满硬痛；大肠属阳明，经气旺于日晡，故日晡潮热（D对）。腹痛腹胀，暴泻如水，肛门灼热为肠道湿热证的临床表现（A错）。大便溏薄，时干时稀，排便不爽为肝郁脾虚证的临床表现（B错）。下痢脓血，里急后重，身热口渴为肠道湿热证的临床表现（C错）。大便燥结，艰涩难下，口干口臭 为肠燥津亏证的临床表现（E错）。